时有膀胱刺激症状，伴排尿困难及尿流中断，改变体位后可继续排尿，应先考虑
A. 急性膀胱炎
B. 急性肾盂肾炎
C. 泌尿系结核
D. 膀胱结石
E. 膀胱肿瘤

正确答案：D。膀胱结石

解析：出现膀胱刺激症状，伴排尿困难及尿流中断，改变体位后可继续排尿（膀胱结石的典型表现），应首先考虑膀胱结石（D对）。急性膀胱炎（A错）主要表现为膀胱刺激症状，可有血尿，一般无排尿困难。急性肾盂肾炎（B错）主要表现为发热、腰痛和膀胱刺激征。泌尿系结核（C错）典型表现为膀胱刺激症状伴终末血尿，可有低热、盗汗等结核中毒症状。膀胱肿瘤（E错）主要表现为间歇性肉眼血尿，可有排尿困难症状，但改变姿势后症状不缓解。